女性，23岁，间歇性吞咽困难3年，X线钡餐检查显示食管下端呈鸟嘴样狭窄，何种疾病可能性最大
A. 食管下段癌
B. 贲门失弛缓症
C. 食管炎
D. 食管疤痕性狭窄
E. 食管平滑肌瘤

正确答案：B。贲门失弛缓症

解析：青年女性患者，间歇性吞咽困难，X线钡餐检查显示食管下端呈鸟嘴样狭窄，结合患者临床表现和影像学检查，可能性最大的诊断为贲门失弛缓症（B对）。贲门失弛缓症主要症状为间歇性咽下困难、胸骨后沉重感或阻塞感，食管吞钡造影典型特征为食管体部蠕动消失，食管下端及贲门部呈鸟嘴状。食管下段癌（A错）多见于中老年人，典型表现为进行性吞咽困难，X线钡餐检查可见食管黏膜皱襞紊乱、充盈缺损、龛影等征象。食管炎（C错）主要表现为“烧心”、吞咽疼痛，钡餐检查多为阴性。食管瘢痕性狭窄（D错）多表现为吞咽困难，无间歇性加重或减轻，钡餐检查提示环形、节段性狭窄等。食管平滑肌瘤（E错）为良性肿瘤，可出现咽下困难、呕吐、消瘦等症状，X线钡餐检查可出现“半月状”压迹。